冠心病心绞痛最主要的病因病机是
A. 气血亏虚
B. 阴阳两虚
C. 气阴两虚
D. 心脉痹阻
E. 气滞血瘀

正确答案：D。心脉痹阻

解析：冠心病心绞痛本由气虚、阴虚、阳虚而心脉失养，引起寒凝、气滞、痰浊、血瘀痹阻心脉，实邪进一步发展，心脉痹阻，则发为心绞痛（D对ABCE错）。